酸蚀釉质粘结面的酸为
A. 25%磷酸液
B. 35%胶状磷酸
C. 45%盐酸
D. 50%枸橼酸
E. 自酸蚀剂

正确答案：B。35%胶状磷酸

解析：牙釉质粘结面的处理：对于牙釉质粘结面，一般采用30%～50%磷酸液处理正常釉质表面30秒即可达到酸蚀的目的。临床上，为了准确控制酸蚀区，常用35%左右的胶状磷酸处理剂。掌握“修复材料、金瓷结合及树脂粘结机制”知识点。